女性，48岁，发热伴对称性多关节肿痛，晨僵3个月，查ANA低滴度强阳性，RF（+）和IgG补体升高，最可能的诊断是
A. 多肌炎
B. 系统性红斑狼疮
C. 类风湿关节炎
D. 干燥综合征
E. 混合性结缔组织病

正确答案：C。类风湿关节炎

解析：中年女性患者（类风湿关节炎好发人群），出现发热伴对称性多关节肿痛、晨僵3个月（类风湿关节炎关节典型表现），RF（类风湿因子）阳性，最可能的诊断为类风湿关节炎（C对）。多肌炎（A错）主要临床表现为对称性四肢近端肌无力，关节较少受累，其特异性抗体抗Jo-1抗体常阳性。80%系统性红斑狼疮（B错）患者在病程中出现皮疹，以鼻梁和双颧颊部蝶形红斑最具特征性，ANA、抗dsDNA抗体及抗Sm抗体阳性，ANA常强阳性。干燥综合征（D错）70%～80%患者诉口干，抗SSA、抗SSB抗体阳性。混合性结缔组织病（E错）是一种同时或不同时具有系统性红斑狼疮、多发性肌炎、硬皮病、类风湿关节炎等疾病的混和表现、血中有高滴度效价的ANA和高滴度U1RNP抗体的疾病，主要表现为雷诺现象、手指肿胀、皮疹、关节及肺部损害等病变。